病因研究中形成病因假设的方法以下哪条不正确
A. 验证法
B. 求同法
C. 求异法
D. 排除法
E. 共变法

正确答案：A。验证法